属于短效β₂受体激动剂，吸入后3～5分钟快速起效，用于缓解轻中度急性哮喘症状的药物是
A. 沙丁胺醇
B. 沙美特罗
C. 异丙托溴铵
D. 多索茶碱
E. 噻托溴铵

正确答案：A。沙丁胺醇